男，48岁。左上腹部外伤3小时，急诊留观时出现口渴、烦躁，左上腹疼痛加剧。体温39.1℃，复查血常规提示白细胞计数明显升高。下一步治疗应选择
A. 大量补液
B. 急诊剖腹探查
C. 皮下注射吗啡
D. 腹部CT检查
E. 抗感染治疗后择期手术

正确答案：B。急诊剖腹探查

解析：中年男性患者，左上腹部外伤后，出现口渴、烦躁，白细胞升高（失血性休克的表现），应考虑腹部实质性器官破裂所致的休克，故应急诊剖腹探查止血（B对），而不应择期手术（E错），以免危及生命。大量补液（A错）可暂时缓解患者休克症状，但不能解决引起失血的根本原因。CT检查（D错）可以明确诊断，但不是治疗措施。对于尚未明确诊断的闭合性腹部损伤的病人，不可皮下注射吗啡（C错）等止痛药，以免掩盖患者病情，延误诊断和治疗。